治疗小儿厌食脾胃气虚证的用方是
A. 健脾丸
B. 异功散
C. 养胃增液汤
D. 参苓白术散
E. 香砂六君子汤

正确答案：B。异功散

解析：厌食脾胃气虚证是由于久病伤脾，损伤脾气，脾失健运所致，治以健脾益气，佐以助运，方药为异功散（B对）。健脾丸（A错）其功用为健脾和胃，消食止泻，适用于积滞之脾虚夹积证。养胃增液汤（C错）其功用为滋养脾胃，佐以助运，适用于厌食之脾胃阴虚证。参苓白术散（D错）其功用为益气健脾、渗湿止泻，适用于脾虚夹湿证。香砂六君子汤（E错）其功用为益气健脾，行气化痰，适用于脾胃气虚，痰阻气滞证。